成人双手占体表面积的
A. 3%
B. 5%
C. 7%
D. 9%
E. 12%

正确答案：B。5%

解析：根据中国新九分法（P138 表13-1），成人双手占体表面积的5%（B对）。烧伤面积记忆总结：头颈面9%；双上肢18%；躯干27%；双下肢46%；双臀5%；双大腿21%；双小腿13%；双足7%；记忆口诀：“3，3，3，5，6，7，外加13，21，还有1个小JJ”。解释：从头往下：发部、面部、颈部：3，3，3；从手掌往上，因手是摸着双臀部的，所以双手掌和双臀部都是5；双前臂6，双上臂7；因谐音“脚气”，双足为7；躯干前和躯干后均为13，双大腿为21，最后剩下会阴部，为1。